生物碱、氰化物、无机磷中毒，洗胃液选用
A. 1：2000～5000高锰酸钾溶液
B. 0.3%过氧化氢溶液
C. 1%～2%氯化钠溶液
D. 3%～5%鞣酸溶液
E. 药用炭、鞣酸、氧化镁混合物

正确答案：A。1：2000～5000高锰酸钾溶液

解析：本题考查常用洗胃液的作用。生物碱、氰化物、无机磷中毒，洗胃液选用1：2000～5000高锰酸钾溶液（A对）。1：2000～5000高锰酸钾溶液为氧化剂，可破坏生物碱及有机物，常用于巴比妥类、阿片类、士的宁、烟碱、奎宁、毒扁豆碱及砷化物、氰化物、无机磷等药物中毒。0.3%过氧化氢溶液（B错）可用于阿片类，氰化物及高锰酸钾中毒。1%～2%氯化钠溶液（C错）用于中毒药物不明的急性中毒，砷化物、硝酸银等药物中毒可用生理盐水。3%～5%鞣酸溶液（D错）可使大部分有机及无机化合物沉淀，如阿扑吗啡、士的宁、生物碱、洋地黄及锰、铅等重金属。药用炭、鞣酸、氧化镁混合物（E错）为强力吸附剂，可阻止毒物吸收，适用于有机及无机毒物中毒。